以下关于腹股沟直疝的描述正确的是
A. 多数能进入阴囊
B. 多见于儿童和青壮年
C. 回纳后压住腹股沟内环，肿块不再突出
D. 极少发生嵌顿
E. 疝囊颈在腹壁下动脉外侧

正确答案：D。极少发生嵌顿

解析：腹股沟直疝是指腹腔内的组织自腹股沟管后壁、直疝三角区域突出形成的疝，常见于年老体弱者（B错），从直疝三角突出，不经过腹股沟管内环故很少能进入阴囊（A错），因此极少发生嵌顿（D对），同理在回纳后压住内环并不能阻止肿块再突出（C错）。因为腹壁下动脉构成了直疝三角的外侧边，故直疝的疝囊颈在腹壁下动脉内侧（E错）。可简单记忆为“内-直，外-斜”：腹壁下动脉的内侧有腹直肌（直疝），外侧有腹外斜肌（斜疝）。